根管治疗失败且不适合根管再治疗的患牙，应进行
A. 根管再治疗
B. 根尖手术
C. 牙周手术
D. 翻瓣术
E. 根尖诱导成形术

正确答案：B。根尖手术

解析：根管治疗失败且不适合根管再治疗，如患牙有良好的桩修复体、无法取出的折断器械或根管超填物、非手术治疗无法修补的根管侧穿等，均为根尖手术的适应证。掌握“根尖手术”知识点。